房间隔缺损X线检查表现为
A. 右房右室大
B. 左室右室大
C. 左室左房大
D. 右室左房大
E. 右房左房大

正确答案：A。右房右室大

解析：先天性心脏病（简称先心病）临床根据左右两侧心腔及大血管之间有无特殊的通道及血液分流的方向分为3大类：1．左向右分流型（潜在青紫型） 常见有房间隔缺损、室间隔缺损和动脉导管未闭，正常时由于体循环压力高于肺循环，左心房压力大于右心房，房间隔缺损时，血液由左向右分流。血液分流后右心血流量增加，舒张期负荷加重，X线检查表现为右房右室扩大（A对）；2．右向左分流型（青紫型） 因某些原因使右心的压力超过左心，使血流经常从右向左分流，而出现持续性青紫，此型常见的有法洛四联症，完全性大血管错位等；3．无分流型 常见有肺动脉狭窄、主动脉缩窄和右位心等。